与食管腺癌病关系密切的病理改变是
A. Barrett上皮
B. 胃上皮化生
C. 乳头状瘤
D. 胃黏膜上皮细胞异型増生
E. 黏膜中性粒细胞浸润

正确答案：A。Barrett上皮

解析：与食管腺癌病关系密切的病理改变是Barrett上皮（A对）。胃上皮化生（B错）与Barrett食管的病理改变（八年制病理学P255）。乳头状瘤（九版病理学P110）是鳞状上皮、尿路上皮等被覆部位，称为鳞状细胞乳头状瘤、尿路上皮乳头状瘤，腺癌是腺上皮的恶性肿瘤，故乳头状瘤（C错）与食管腺癌无关。胃黏膜上皮细胞异型増生（D错）胃癌的癌前病变（P364）。黏膜中性粒细胞浸润（E错）是反流性食管炎的病理变化，长期慢性炎症可形成Barrett食管（九版病理学P209）。